盆腔炎性疾病时输卵管卵巢病理变化不包括
A. 慢性输卵管炎
B. 输卵管积水
C. 输卵管卵巢炎
D. 输卵管卵巢囊肿
E. 输卵管卵巢脓肿

正确答案：D。输卵管卵巢囊肿

解析：盆腔炎性疾病时输卵管卵巢病理变化包括急性输卵管炎、输卵管积脓、输卵管卵巢脓肿（E对）。当急性输卵管炎未经治疗或治疗不彻底时可转变为慢性输卵管炎（A对），若输卵管伞端闭锁、浆液性渗出物聚集形成输卵管积水（B对）或输卵管积脓或输卵管卵巢脓肿的脓液吸收，被浆液性渗出物代替形成输卵管积水或输卵管卵巢囊肿（D对）。卵巢很少单独发炎，常与输卵管伞端粘连而发生输卵管卵巢炎（C对）。本题无正确答案。